某男，45岁。双眼睑下垂6～7天，渐加重，近一两天四肢活动无力，晨起轻，下午中，休息后减轻，活动后加重，诊断为重症肌无力。对该病人最好用哪种药物治疗
A. 毛果芸香碱
B. 毒扁豆碱
C. 新斯的明
D. 阿托品
E. 加兰他敏

正确答案：C。新斯的明

解析：本题考查重症肌无力的治疗。某男，45岁。双眼睑下垂6～7天，渐加重，近一两天四肢活动无力，晨起轻，下午中，休息后减轻，活动后加重，诊断为重症肌无力，应采用新斯的明（C对）治疗。毛果芸香碱（A错）能直接作用于副交感神经（包括支配汗腺的交感神经）节后纤维支配的效应器官的M胆碱受体，对眼和腺体作用较明显，临床常用于青光眼、虹膜睫状体炎的治疗，还可用于治疗口腔干燥、抗胆碱药阿托品中毒的解救。毒扁豆碱（B错）属于易逆行抗抗胆碱酯酶药，主要用于青光眼的治疗，也可用于M胆碱受体阻断剂如阿托品等药物中毒的解救。阿托品（D错）可竞争性拮抗M胆碱受体。可用于解除平滑肌痉挛、抑制腺体分泌、缓慢型心律失常、抗休克、解救有机磷酸酯类中毒等。加兰他敏（E错）其抗胆碱酯酶作用较弱，易透过血脑屏障，故中枢作用较强，可用于重症肌无力，小儿麻痹后遗症。